患者，女，59岁。两膝关节红肿热痛，尤以右膝部为重，痛不可触，关节活动不利，并见身热，口渴，舌苔黄燥，脉滑数。治疗除选用犊鼻、梁丘、阳陵泉、膝阳关外，还应加
A. 大椎、曲池
B. 肾俞、关元
C. 脾俞、气海
D. 脾俞、胃俞
E. 肾俞、合谷

正确答案：A。大椎、曲池

解析：本题考查常见的病症的辩证、处方。题中患者两膝关节红肿热痛，尤以右膝部为重，痛不可触，关节活动不利，可辩证为痹症，并见身热，口渴，舌苔黄燥，脉滑数可进一步辩证为热痹症。大椎、曲池合用可用于治疗热痹症（A对）。肾俞、关元合用可用于治疗风寒湿痹中的痛痹症（B错）。脾俞、气海合用可用于治疗肺气不足（C错）。脾俞、胃俞合用可用于治疗泄泻等病症（D错）。中极、三阴交、肾俞、合谷、四满、三里等合用可治疗月经不调等病症（E错）。